前磨牙体积最大的牙齿是
A. 下颌第一前磨牙
B. 上颌第一前磨牙
C. 上颌第二前磨牙
D. 下颌第二前磨牙
E. 上颌尖牙

正确答案：B。上颌第一前磨牙

解析：本题考查前磨牙大小形态对比。上颌第一前磨牙（B对）是前磨牙中体积最大的牙齿。下颌第一前磨牙（A错）是前磨牙中体积最小的牙。下颌第二前磨牙（D错）较下颌第一前磨牙体积稍大，但较上颌第二前磨牙小。上颌第二前磨牙（C错）与上颌第一前磨牙形态相似，体积较上颌第一前磨牙小。